以下哪种患者不宜使用胰岛素治疗
A. 糖尿病合并重症感染
B. 糖尿病合并急性心肌梗死
C. 糖尿病合并脑血管意外
D. 糖尿病需急症手术者
E. 肥胖糖尿病患者饮食管理﹢运动疗法控制不佳者

正确答案：E。肥胖糖尿病患者饮食管理﹢运动疗法控制不佳者